有利于形成煤烟型烟雾事件的条件不包括
A. 地势低凹
B. 逆温
C. 空气潮湿
D. 气温高
E. 空气中SO₂污染严重

正确答案：D。气温高

解析：本题考查有利于形成煤烟型烟雾事件的条件。煤烟型烟雾事件的污染来源是煤和石油制品燃烧；主要污染物是颗粒物、SO₂（E对）、硫酸雾；发生季节多在冬季；发生时间多在早晨；气象条件多为气温低（D错，为本题正确答案）、气压高、风速很低、湿度高（C对）、有雾；逆温类型是辐射逆温（B对）；地理条件为河谷或盆地（A对）易发生。